雌激素结合的受体类别是
A. G蛋白偶联受体
B. 离子通道受体
C. 细胞内受体
D. 细胞因子受体
E. 酪氨酸激酶受体

正确答案：C。细胞内受体

解析：雌激素是类固醇激素的一种，因为是脂溶性信号分子，故可自由穿过细胞膜，结合于细胞内核受体(C对）。其他核内受体的配体还有：甲状腺激素、维甲酸（视磺酸），维生素D等。